国内企业研发，作用于VEGFR-2，分子中含有氰基，可用于治疗晚期胃癌的药物是
A. 吉非替尼
B. 伊马替尼
C. 阿帕替尼
D. 索拉替尼
E. 埃克替尼

正确答案：C。阿帕替尼

解析：本题考查阿帕替尼。阿帕替尼（C对）是国内企业研发，作用于VEGFR-2，分子中含有氰基，可用于治疗晚期胃癌的药物。吉非替尼（A错）是第一个选择性表皮生长因子受体酪氨酸激酶抑制剂，用于非小细胞肺癌、转移性非小细胞肺癌治疗。甲磺酸伊马替尼（B错）是第一个上市的蛋白酪氨酸激酶抑制剂，用于治疗费城染色体阳性的慢性粒细胞白血病和恶性胃肠道间质肿瘤。索拉替尼（D错）是一种多激酶抑制剂。埃克替尼（E错）作用于EGFR，用于局部晚期或转移的非小细胞肺癌治疗。